我国孕产妇死亡的第一位原因为
A. 产后出血
B. 妊娠高血压综合征
C. 羊水栓塞
D. 妊娠合并心脏病
E. 产褥感染

正确答案：A。产后出血